对α₂受体有选择性激动作用的药物是
A. 可乐定
B. 哌唑嗪
C. 普萘洛尔
D. 琥珀胆碱
E. 去甲肾上腺素

正确答案：A。可乐定

解析：本题考查对α₂受体有选择性激动作用的药物。可乐定（A对）是α₂受体激动药，可有效抑制中枢神经系统蓝斑神经核神经元去甲肾上腺素能神经冲动的传导，并抑制节前交感神经活动。哌唑嗪（B错）为选择性α₁受体阻断剂。普萘洛尔（C错）为非选择性β受体阻断剂。琥珀胆碱（D错）属于骨骼肌松弛药，在临床上多用于局部麻醉，可引起心动过缓、心率失常。去甲肾上腺素（E错）主要激动α受体，对α₁、α₂均有效。